夏枯草具有的功效是
A. 散结消肿
B. 润肠通便
C. 祛风明目
D. 疏风散热
E. 清热利湿

正确答案：A。散结消肿

解析：夏枯草为清热泻火药，性味辛苦、寒，归肝，胆二经，具有清肝泻火，明目，散结消肿的功效（A对）。夏枯草常用来治疗肝火上炎所致的目赤肿痛、目珠夜痛、头痛目眩，及瘰疬、瘿瘤、乳痈、乳痛等郁结不通之症。